阿托品常引起口干、尿潴留、视力模糊，属于
A. 副作用
B. 毒性反应
C. 后遗效应
D. 继发反应
E. 首剂效应

正确答案：A。副作用

解析：本题考查药品的不良反应。阿托品常引起口干、尿潴留、视力模糊，属于副作用（A对）。副作用是指在药物按正常用法用量使用时，出现的与治疗目的无关的不适反应。如阿托品用于解除胃肠痉挛时，会引起口干、尿潴留、视力模糊等副作用。毒性反应（B错）是指在药物剂量过大或体内蓄积过多时发生的危害机体的反应。后遗效应（C错）是指在停药后血药浓度已降低至最低有效浓度以下时仍残存的药理效应。继发反应（D错）是由于药物的治疗作用所引起的不良反应。首剂效应（E错）是指一些患者在初服某种药物时，由于机体对药物作用尚未适应而引起不可耐受的强烈反应。例如哌唑嗪等按照常规剂量开始治疗常可致血压骤降。